上颌牙槽嵴两侧远中的圆形骨突，总义齿基托应覆盖的部位
A. 切牙乳突
B. 上颌结节
C. 腭小凹
D. 颊棚区
E. 磨牙后垫

正确答案：B。上颌结节

解析：本题考查种植覆盖全口义齿。上颌结节为上颌牙槽嵴两侧远中端的圆形骨突，上颌总义齿的基托应覆盖整个上颌结节（B对）。